影响中药质量的因素，除品种外，主要还有
A. 栽培
B. 产地
C. 采收加工
D. 贮藏
E. 运输

正确答案：A、B、C、D、E。栽培；产地；采收加工；贮藏；运输

解析：本题考查的是影响中药质量的因素。影响中药质量的因素，除品种外，主要还有栽培（A对）、产地（B对）、采收加工（C对）、贮藏（D对）与运输（E对）。中药材生产过程中的品种、产地、种养环境、采收加工及贮藏养护等因素都会影响药材质量。栽培对药物质量的影响：中药材的生产主要有两种途径，即野生和栽培（养殖）。栽培过程中种植技术粗放、盲目扩大种植范围，造成种质不佳，种质退化严重；滥施农药、除草剂，过量使用化肥，造成中药材中农药残留和重金属含量偏高，影响药材的安全性和有效性。在科学研究的基础上，对中药材的生产过程进行科学的管理，是提高药材质量和保证药材质量稳定的基础与关键。中药在运输过程中可能混入杂质，影响中药质量。